下列哪个不是评价儿童青少年营养状况的方法
A. 年龄别体重
B. 身高别体重
C. 年龄别身高
D. 身高体重指数
E. 皮褶厚度

正确答案：D。身高体重指数